对发色剂描述不正确的是
A. 可使食物中某些无色基团呈色
B. 通过化学反应使食物显色
C. 使食品在加工中不褪色
D. 本身无着色作用
E. 本身有着色作用

正确答案：E。本身有着色作用